用于杀灭滴虫，也对抑制革兰氏阴性厌氧菌和螺旋体特别有效的是
A. 麝香草酚
B. 氯己定
C. 四环素
D. 磺胺类
E. 甲硝唑

正确答案：E。甲硝唑

解析：甲硝唑（灭滴灵），是常用的治疗厌氧菌感染的药物，其最初被用于治疗滴虫性阴道炎，还能有效地杀灭牙龈卟啉单胞菌、中间普氏菌、螺旋体等细菌。掌握“慢性牙周炎的治疗原则、程序及方法”知识点。